关于无菌创口的处理原则，说法正确的是
A. 面部的无菌创口可在术后半月开始拆线
B. 面部的无菌创口一般要延期拆线
C. 面部严密缝合的创口可早期暴露，并以过氧化氢、硼酸及酒精混合液清除渗出物
D. 光刀手术的创口，拆线时间应推迟至术后一个月
E. 颈部缝线可在术后3天左右拆除

正确答案：C。面部严密缝合的创口可早期暴露，并以过氧化氢、硼酸及酒精混合液清除渗出物

解析：本题考查无菌创口的处理原则。关于无菌创口的处理原则，说法正确的是面部严密缝合的创口可早期暴露，并以过氧化氢、硼酸及酒精混合液清除渗出物（C对）。切忌渗出物凝聚、结痂、成块，造成感染或影响创口愈合。面部的清洁创口一般可早期拆线（B错），张力过大或有手术特殊要求者除外，由于面部血液循环丰富，生长力强，可在术后5天开始拆线（A错）。颈部缝线可在术后7天左右拆除（E错）。光刀手术的创口，拆线时间应推迟至术后14天（D错）。